结核性胸膜炎患者，除抗结核治疗外，减轻胸膜肥厚最重要的措施是
A. 反复胸腔穿刺抽液
B. 胸腔内注入抗结核药物
C. 胸腔内注射糜蛋白酶
D. 口服糖皮质激素
E. 胸腔内注射尿激酶

正确答案：A。反复胸腔穿刺抽液

解析：结核性胸膜炎根据病变性质可分干性和湿性两种，以湿性结核性胸膜炎为常见。湿性结核性胸膜炎又称渗出性结核性胸膜炎，病变主要为浆液纤维素性炎，一般经适当治疗可吸收，如渗出物中纤维素较多，不易吸收，则可因机化而使胸膜增厚粘连，因此应尽早穿刺抽液（A对）。一般情况下，抽胸水后，没必要胸腔内注入抗结核药物（B错），但可注入链激酶等防止胸腔粘连。糜蛋白酶（C错）主要用于痰液的稀化，便于咳出。糖皮质激素疗效不肯定（D错），如全身毒性症状严重、大量胸水者，在抗结核治疗的同时，可尝试加用泼尼松。尿激酶（E错）直接作用于内源性纤维蛋白溶解系统从而发挥溶栓作用，还能提高血管ADP酶活性，抑制ADP诱导的血小板聚集，预防血栓形成。